显微血管外科一般系指血管外径在
A. 0.5mm以下的血管外科手术而言
B. 1mm以下的血管外科手术而言
C. 1.5mm以下的血管外科手术而言
D. 2mm以下的血管外科手术而言
E. 2.5mm以下的血管外科手术而言

正确答案：D。2mm以下的血管外科手术而言

解析：本题考查口腔颌面部后天畸形概论。显微血管外科：一般系指外径在2mm以下的血管外科手术而言（D对）。血管外径在2mm以上者，可不用手术显微镜或放大镜下进行手术操作。